肾上腺皮质激素的分泌率最高出现在
A. 夜间4时
B. 早晨6时
C. 上午8时
D. 上午10时
E. 夜间12时

正确答案：C。上午8时

解析：本题考查肾上腺皮质激素的分泌。肾上腺皮质激素的分泌率最高出现在上午8时（C对）。人体糖皮质激素的分泌具昼夜节律性，由于皮质醇的分泌呈阵发性，血浆浓度常出现较大的峰形波动。且存在昼夜节律变化。一日上午8时左右为分泌高潮，随后逐渐下降，午夜12时为低潮，这是由ACTH分泌的昼夜节律所引起的。